肾病综合征患儿，口服泼尼松2mg/kg·d，治疗2周后尿蛋白完全转阴，8周后，尿蛋白再次（++++）。疗效判断为
A. 复发
B. 激素敏感
C. 激素耐药型
D. 激素依赖型
E. 激素部分敏感型

正确答案：A。复发

解析：肾病综合征（NS）是指由多种原因引起的肾小球基底膜通透性增加，导致血浆内大量蛋白质从尿中丢失的临床综合征。大量蛋白尿、低白蛋白血症、高脂血症、明显水肿是其临床特点。该患儿口服泼尼松（糖皮质激素）治疗2周后，尿蛋白完全转阴（起始有效），8周后尿蛋白再次（++++），疗效判断为复发（A对），即进入恢复期，已稳定一段时间后，原本已转阴的尿蛋白再次转为阳性。激素敏感型（B错）指用激素治疗8～12周内有效，NS好转。激素耐药型（C错）即激素抵抗型，指激素治疗无效，尿蛋白持续阳性。激素依赖型（D错）是指激素起始治疗有效，尿蛋白转阴，但减量到一定程度后复发，尿蛋白再次转阳，此例题中未提及减量。激素部分敏感型（E错）指治疗部分缓解，尿蛋白下降，但未完全转阴。